下列医疗器械产品中，国家实行第二类管理的是
A. 拔罐器
B. 助听器
C. 一次性使用无菌注射器
D. 创可贴
E. 弹力绷带

正确答案：B。助听器